具有利湿退黄，散瘀止痛功效的药物是
A. 茵陈
B. 萆薢
C. 虎杖
D. 地肤子
E. 金钱草

正确答案：C。虎杖

解析：该题考查虎杖的功效。虎杖味微苦，性微寒，入肝、胆、肺经，其功效为利湿退黄，清热解毒，散瘀止痛，化痰止咳（C对）。